乳牙患龋几岁达到患龋高峰
A. 2～3岁
B. 3～4岁
C. 5～8岁
D. 9～10岁
E. 11～12岁

正确答案：C。5～8岁

解析：本题考查乳牙龋。我国乳牙患龋情况的报道显示1岁左右起即直线上升，5～8岁（C对）时达到高峰。